口腔预防医学开始发展的时间是
A. 18世纪末
B. 20世纪中期
C. 19世纪初
D. 19世纪末
E. 20世纪初

正确答案：B。20世纪中期

解析：本题考查口腔预防医学开始发展的时间。我国口腔预防医学开始发展的时间是20世纪中期（B对），20世纪中期以后是口腔预防医学全面发展的时代。口腔预防医学是指通过有组织的社会努力，预防口腔疾病发生，维护口腔健康及提高生命质量的科学与艺术，是口腔医学的一门分支学科和重要组成部分，与口腔医学的各领域都有着密切的内在联系。